安排饮片斗谱时，不能排于一斗或上下药斗中的是
A. 麻黄与桂皮
B. 陈皮与青皮
C. 酸枣仁与远志
D. 乌头与天花粉
E. 板蓝根与大青叶

正确答案：D。乌头与天花粉

解析：本题考查的是斗谱排列时还应参考的其他原则。安排饮片斗谱时，不能排于一斗或上下药斗中的是乌头与天花粉（D对）。中药斗谱应根据中药的性能和中医处方用药的配伍规律以及医院饮片品种和使用频率、医院专科设置、医院用药特色、医师用药习惯等情况，按照知识性、科学性和方便性、安全性的原则进行设计，合理有序地存放。斗谱编排是否科学、合理，直接影响配方效率和质量，但一般都是根据各药使用的不同频率以及药物的性质而安排的。斗谱编排基本原则：（1）按饮片使用频率排序。常用药物应放在斗架的中上层，便于调剂操作。如黄芪、党参与甘草；当归、白芍与川芎；麦冬、天冬与北沙参；肉苁蓉、巴戟天与补骨脂；金银花、连翘与板蓝根；防风、荆芥与白芷；柴胡、葛根与升麻；砂仁、豆蔻与木香；黄芩、黄连与黄柏；厚朴、香附与延胡索；焦麦芽、焦山楂与焦神曲；酸枣仁、远志与柏子仁；苦杏仁、桔梗与桑白皮；天麻、钩藤与蒺藜；陈皮、枳壳与枳实；附子、干姜与肉桂；山药、泽泻与牡丹皮等。（2）按饮片的质地轻重排序。质地较轻且用量较少的药物，应放在斗架的高层。如月季花、白梅花与佛手花；玫瑰花、代代花与厚朴花；地骨皮、千年健与五加皮；络石藤、青风藤与海风藤；密蒙花、谷精草与木贼草等。质地沉重的矿石、化石、贝壳类药物和易于造成污染的药物（如炭药），多放在斗架的较下层。前者如磁石、赭石与紫石英，龙骨、龙齿与牡蛎，石决明、珍珠母与瓦楞子，石膏、寒水石与海蛤壳等；后者如藕节炭、茅根炭与地榆炭，大黄炭、黄芩炭与黄柏炭，艾炭、棕榈炭与蒲黄炭等。质地松泡且用量较大的药物，多放在斗架最低层的大药斗内。如芦根与茅根；茵陈与金钱草；白花蛇舌草与半枝莲；灯心草与通草；竹茹与丝瓜络；薄荷与桑叶；荷叶与荷梗。（3）按饮片药用部位或功效排列。如将饮片按其入药部位分为根茎、皮、花、果实种子、全草、动物、矿物等若干类，或按其功效分为止咳平喘类、理气类、清热类、活血化瘀类等若干类，每类饮片相对集中并逐类按一定顺序排列，这种斗谱排列的特点是分类清楚，便于熟悉记忆，适用于饮片品种少、配方量小的医院。（4）将同一处方中经常一起配伍应用的，如“相须”“相使”配伍的饮片、处方常用的“药对”药物可同放于一个斗中。如麻黄、桂枝（A错）；酸枣仁、远志（C错）；射干、北豆根；党参、黄芪；桃仁、红花；杜仲、续断；陈皮、青皮（B错）；泽泻、猪苓；山药、薏苡仁；板蓝根、大青叶（E错）；辛夷、苍耳子；火麻仁、郁李仁；羌活、独活；苍术、白术；麦冬、天冬；川乌、草乌；知母、浙贝母；蒲公英、紫花地丁；萹蓄、瞿麦；三棱、莪术；乳香、没药；小茴香、橘核。根据各医院、药房的实际情况和用药习惯，在实际编排斗谱时应灵活选择、应用上述原则，初步制定斗谱后，在实际工作中，可根据使用情况随时调整。2.斗谱排列时还应参考的其他原则：有些药物放在一起可能造成意外事故的发生，因此在摆放时应注意以下几点。（1）属于配伍禁忌的药物，不能装于一斗或上下药斗中。如甘草与京大戟、甘遂、芫花；藜芦与丹参、南沙参、玄参、苦参、白芍、赤芍、细辛；乌头类（附子、川乌及草乌）与半夏的各种炮制品、瓜蒌（瓜蒌皮、瓜蒌子、瓜蒌仁及天花粉）；丁香（包括母丁香）与郁金（黄郁金、黑郁金）；芒硝（包括玄明粉）与京三棱；肉桂（官桂）与石脂（赤石脂）均不宜放在一起。（2）外观性状相似的饮片，尤其是外观形状相似但功效不同的饮片，不宜排列在一起。如蒲黄与海金沙，紫苏子与菟丝子，山药与天花粉，杏仁与桃仁，厚朴与海桐皮，荆芥与紫苏叶，大蓟与小蓟，炙甘草与炙黄芪，当归与独活，制南星与象贝（浙贝），菟丝子与苏子，熟地与黄精，知母与玉竹，蛇床子与地肤子，玫瑰花与月季花，血余炭与干漆炭，韭菜子与葱子等。（3）药名相近，但性味功效不同的饮片不应排列在一起。如附子与白附子，藜芦与漏芦，天葵子与冬葵子等。（4）同一植物来源但不同部位入药的并且功效不相同的饮片不能排列在一起，如麻黄与麻黄根。（5）为防止灰尘污染，有些中药不宜放在一般的药斗内，而宜存放在加盖的瓷罐中，以保持清洁卫生。如熟地黄、龙眼肉、青黛、玄明粉、松花粉、生蒲黄、乳香面、没药面、儿茶面、血竭面等。（6）有恶劣气味的药物，不能与其他药物装于一个药斗中。如阿魏、鸡矢藤等。（7）贵细药品（价格昂贵或稀少的中药）不能存放在一般的药斗内，应设专柜存放，由专人管理，每天清点账物。如牛黄、麝香、西红花、人参、西洋参、羚羊角、鹿茸、珍珠、冬虫夏草、海龙、海马等。（8）毒性中药和麻醉中药应按照有关规定存放，绝不能放于一般药斗内，必须专柜、专锁、专账、专人管理，严防意外事故的发生。